未经批准，某企业擅自出口麻醉药品
A. 没收全部麻醉药品和非法所得、罚款或停业整顿
B. 以生产、贩卖毒品论处
C. 以生产毒品论处
D. 给予行政处分
E. 判二年以下徒刑

正确答案：A。没收全部麻醉药品和非法所得、罚款或停业整顿

解析：本题考查经营企业的法律责任。未经批准，某企业擅自出口麻醉药品应没收全部麻醉药品和非法所得、罚款或停业整顿（A对）。根据《麻醉药品和精神药品管理条例》第六十八条规定，定点批发企业违反规定销售麻醉药品和精神药品，或者违反规定经营麻醉药品原料药和第一类精神药品原料药的，由药品监督管理部门责令限期改正，给予警告，并没收违法所得和违法销售的药品；逾期不改正的，责令停业，并处违法销售药品货值金额两倍以上五倍以下的罚款；情节严重的，取消其定点批发资格。